小儿内服使君子，每日的最大用量是
A. 20粒
B. 25粒
C. 30粒
D. 40粒
E. 50粒

正确答案：A。20粒

解析：本题考查的是使君子的用法用量。小儿内服使君子，每日的最大用量是20粒（A对）。使君子：【用法用量】内服：煎汤，9～12g，去壳取仁，捣碎。小儿每岁每天1～1.5粒，每日总量不超过20粒。或入丸散，或炒香嚼服。空腹用，连用2～3天。